鉴定矿物类中药的透明度时，应将矿物磨成的标准厚度是
A. 0.03cm
B. 0.03mm
C. 0.03μm
D. 0.03nm
E. 0.03dm

正确答案：B。0.03mm

解析：本题考查的是矿物类中药的透明度。鉴定矿物类中药的透明度时，应将矿物磨成的标准厚度是0.03mm（B对）。矿物类中药的透明度：矿物透光能力的大小称为透明度。将矿物磨成0.03mm标准厚度后，比较其透明度，可分为三类：透明矿物、半透明矿物和不透明矿物。